预防宫颈癌普查的方法为
A. 妇科盆腔检查
B. 阴道宫颈细胞涂片
C. 阴道B超
D. 宫颈组织活检
E. 阴道镜检查

正确答案：B。阴道宫颈细胞涂片

解析：本题考查预防宫颈癌普查的方法。阴道宫颈细胞涂片（B对ACDE错）检查是宫颈癌普查中最常用的方法，简单易行，准确率高，90%～95%的早期癌症都能通过其发现，是宫颈早期诊断最实用、有效的方法。